属于DNA病毒的肝炎病毒是
A. HBV
B. HEV
C. HDV
D. HCV
E. HAV

正确答案：A。HBV

解析：肝炎病毒可分为HAV（甲型）、HBV（乙型）、HCV（丙型）、HDV（丁型）和HEV（戊型），其中HBV（A对）是DNA病毒，其余均为RNA病毒。